含有30%短效胰岛素的药物是
A. 低精蛋白锌胰岛素
B. 预混胰岛素类似物（预混门冬胰岛素30）
C. 甘精胰岛素
D. 预混胰岛素（30R）
E. 赖脯胰岛素

正确答案：D。预混胰岛素（30R）

解析：本题考查预混胰岛素(30R）。含有30%短效胰岛素的药物是预混胰岛素（30R）（D对）。低精蛋白锌胰岛素（A错）为中效胰岛素。预混胰岛素类似物(预混门冬胰岛素30）（B错）皮下注射后约0.17～0.33小时内起效，可以较好的控制餐后高血糖。甘精胰岛素（C错）为超长效胰岛素。赖脯胰岛素（E错）皮下注射后约10～15分钟内起效，主要用于控制餐后血糖。